颞下颌关节紊乱综合征属于
A. 内科心身疾病
B. 儿科心身疾病
C. 外科心身疾病
D. 口腔科心身疾病
E. 皮肤科心身疾病

正确答案：D。口腔科心身疾病

解析：口腔科心身疾病：复发性慢性口腔溃疡、颞下颌关节紊乱综合征、特发性舌痛症等。掌握“心身疾病”知识点。